小儿咳嗽变异性哮喘诊断的基本条件是
A. 咳嗽持续＞4周，常在夜间和（或）清晨发作或加剧，以干咳为主
B. 咳嗽反复发作
C. 咳嗽经抗生素治疗有效
D. 有个人或家庭过敏史
E. 用支气管扩张剂可使咳嗽发作缓解

正确答案：A。咳嗽持续＞4周，常在夜间和（或）清晨发作或加剧，以干咳为主

解析：咳嗽持续（A对）需要＞4周，常在夜间和（或）清晨发作或加剧，以干咳为主是咳嗽变异型哮喘的基本诊断条件。咳嗽变异型哮喘亦由气道高反应性引起多种细胞与细胞组分共同参与的气道慢性炎症性疾病。支气管舒张剂可缓解支气管痉挛使咳嗽缓解不是咳嗽变异型哮喘的基本诊断条件（E错）。咳嗽经抗生素治疗有效（C错）说明是细菌感染引起的咳嗽，而非哮喘。有个人或家庭过敏史（D错）是哮喘的发病机制之一，不是诊断基本条件。咳嗽反复发作（B错）需排除其他原因才能作为诊断基本条件。